蕲蛇药材具有
A. “挂甲”
B. “剑脊”
C. “方胜纹”
D. “通天眼”
E. “当门子”

正确答案：C。“方胜纹”

解析：本题考查的是蕲蛇药材的性状鉴别。蕲蛇药材具有“方胜纹”（C对）。蕲蛇：【性状鉴别】药材卷呈圆盘状。头在中间稍向上，呈三角形而扁平，吻端向上，习称“翘鼻头”。上腭有管状毒牙，中空尖锐。背部两侧各有黑褐色与浅棕色组成的“V”形斑纹17～25个，其“V”形的两上端在背中线上相接，习称“方胜纹”，有的左右不相接，呈交错排列。腹部撑开或不撑开，灰白色，鳞片较大，有黑色类圆形的斑点，习称“连珠斑”；腹内壁黄白色，脊椎骨棘突较高，呈刀片状上突，前后椎体下突基本同形，多为弯刀状，向后倾斜，尖端明显超过椎体后隆面。尾部骤细，末端有三角形深灰色的角质鳞片1枚。气腥，味微咸。“挂甲”（A错）为牛黄药材的鉴别特征。牛黄：【性状鉴别】药材多呈卵形、类球形、三方形或四角形，大小不一，少数呈管状或碎片。表面黄红色至棕黄色，有的表面挂有一层黑色光亮的薄膜，习称“乌金衣”，有的粗糙，具疣状突起，有的具龟裂纹。体轻，质酥脆，易分层剥落，断面金黄色，可见细密的同心层纹，有的夹有白心。气清香，味先苦而后甘，有清凉感，嚼之易碎，不粘牙。牛黄水液可使指甲染黄，习称“挂甲”。“剑脊”（B错）为乌梢蛇药材的鉴别特征。乌梢蛇：【性状鉴别】药材呈圆盘状。表面黑褐色或绿黑色，密被菱形鳞片；背鳞行数成双，背中央2～4行鳞片强烈起棱，形成两条纵贯全体的黑线。头盘在中间，扁圆形，眼大而下凹陷，有光泽。脊部高耸成屋脊状。腹部剖开边缘向内卷曲，脊肌肉厚，黄白色或淡棕色，可见排列整齐的肋骨。尾部渐细而长，尾下鳞双行。剥皮者仅留头尾之皮，中段较光滑。气腥，味淡。“通天眼”（D错）为羚羊角药材的鉴别特征。羚羊角：【性状鉴别】药材呈长圆锥形，略呈弓形弯曲。类白色或黄白色，基部稍呈青灰色。嫩枝对光透视有“血丝”或紫黑色斑纹，光润如玉，无裂纹，老枝有细纵裂纹。除顶端部分外，有10～16个隆起环脊，用手握之，四指正好嵌入凹处。角基部横截面类圆形，内有坚硬质重的角柱，习称“骨塞”。除去“骨塞”后，角的下半部呈空洞，全角呈半透明，对光透视，上半段中央有一条隐约可辨的细孔道直通角头，习称“通天眼”。质坚硬，气微，味淡。“当门子”（E错）为麝香药材的鉴别特征。麝香：【性状鉴别】药材麝香仁野生者质软，油润，疏松；其中呈不规则圆球形或颗粒状者习称“当门子”，表面多呈紫黑色，油润光亮，微有麻纹，断面深棕色或黄棕色；粉末状者多成棕褐色或黄棕色，并有少量脱落的内层皮膜和细毛。养殖者呈颗粒状、短条形或不规则团块；表面不平，紫黑色或深棕色，显油性，微有光泽，并有少量毛和脱落的内层皮膜。香气浓烈而特异，味微辣、微苦带咸。